第一个萌出的恒牙为
A. 切牙
B. 尖牙
C. 第一前磨牙
D. 第二前磨牙
E. 第一磨牙

正确答案：E。第一磨牙

解析：第一个萌出的恒牙为第1磨牙(E对)。